剧烈呕吐可引起的是
A. 低氯性碱中毒
B. 高氯性酸中毒
C. 高氯性碱中毒
D. 低氯性酸中毒
E. 呼吸性碱中毒

正确答案：A。低氯性碱中毒

解析：代谢性碱中毒是由于体内H+丢失或HCO₃⁻增多所引起，常见病因有：1.胃液丢失过多，如严重呕吐，长期胃肠减压等；2.碱性物质摄入过多；3.缺钾；4.某些利尿剂的应用。低氯性碱中毒（A对）为代谢性碱中毒的一种类型。